维生素B₆的生理功能是
A. 参与体内物质代谢和能量代谢
B. 参与氨基酸代谢
C. 葡萄糖耐量因子的组成成分
D. 维持皮肤黏膜的完整性
E. 以上全是

正确答案：B。参与氨基酸代谢